长期吃精细的米面容易缺乏
A. VitA
B. VitB
C. VitC
D. VitD
E. VitE

正确答案：B。VitB

解析：维生素B1是水溶性维生素，依赖食物提供，体内很少蓄积，缺乏时，会导致慢性末梢神经炎和其他神经肌肉变性病变，即脚气病，缺乏症多见于以精细米面为主食的地区（B对）。